有五个不同职业人群的冠心病患病率资料，若比较职业不同患病率是否相同。统计学检验的无效假设应是
A. H0：p1=p2=p3=p4=p5
B. H0：p1=p2=p3=p4＞p5
C. H0：π1=π2≠π3=π4=π5
D. H0：π1≠π2≠π3≠π4≠π5
E. H0：π1=π2=π3=π4=π5

正确答案：E。H0：π1=π2=π3=π4=π5

解析：有五个不同职业人群的冠心病患病率资料，若比较职业不同患病率是否相同，即为多个样本率的比较，应选用R×C列联表资料的χ²检验。其无效假设H₀：π₁=π₂=π₃=π₄=π₅（E对CD错）。π表示总体率，而P（AB错）表示样本率。